戊二醛-酚溶液使用的稀释度是
A. 1：2
B. 1：4
C. 1：8
D. 1：16
E. 1：32

正确答案：D。1：16

解析：本题考查戊二醛-酚溶液使用的稀释度。戊二醛-酚溶液属醛类消毒剂，它是碱性戊二醛与石碳酸钠缓冲到pH7.4形成的戊二醛与酚的复合物，用作高效消毒剂，使用1：16稀释度（D对）。